影晌心室充盈的是
A. 肌浆网Ca2+摄取能力下降
B. 肌浆网Ca2+储存减少
C. 两者均有
D. 两者均无
E. 无

正确答案：A。肌浆网Ca2+摄取能力下降

解析：心衰时，心肌细胞缺血缺氧，ATP供应不足，肌浆网上Ca2+-ATP酶含量或活性降低，使肌浆网摄取Ca2+能力下降（A对），导致心室舒张时肌浆网摄取Ca2+减少，胞质Ca2+浓度不能迅速降低，心肌舒张延缓，影响心室充盈。